较为常用，已被载入《中国药典》的包合材料是
A. 葡糖基-β-CD
B. 乙基-β-CD
C. α-CD
D. γ-CD
E. β-CD

正确答案：E。β-CD